桑螵蛸功效除固精缩尿外还能
A. 补肾助阳
B. 补脾止泻
C. 补肺定喘
D. 补肝明目
E. 补心定惊

正确答案：A。补肾助阳

解析：本题考查的是桑螵蛸的功效。桑螵蛸功效除固精缩尿外还能补肾助阳（A对）。桑螵蛸：【功效】固精缩尿，补肾助阳。莲子肉：【功效】补脾止泻（B错），益肾固精，止带，养心安神。蛤蚧：【功效】补肺气，定喘嗽（C错），助肾阳，益精血。枸杞子：【功效】滋补肝肾，明目（D错），润肺。功效为补心定惊（E错）的中药，2022年考试指南未明确说明。